既能润肺止咳，又能润肠通便的药物是
A. 郁李仁
B. 薏苡仁
C. 松子仁
D. 火麻仁
E. 酸枣仁

正确答案：C。松子仁

解析：该题考查松子仁的功效。松子仁肝温，入肺、肝、大肠经。质润气香，甘润入肠而能润肠通便。质润入肺而有润肺止咳之功（C对）。